儿童患流行性腮腺炎时常见的并发症是
A. 脑膜炎
B. 肺炎
C. 肝炎
D. 肾炎
E. 睾丸炎或卵巢炎

正确答案：E。睾丸炎或卵巢炎

解析：腮腺炎病毒是流行性腮腺炎的病原体，只有一个血清型。病毒通过飞沫或唾液污染食具或玩具传播。学龄儿童为易感者。潜伏期7～25天，引起一侧或双侧腮腺肿大，若无合并感染，病程1～2周自愈。感染者可引起睾丸炎、卵巢炎等并发症。掌握“正、副黏病毒”知识点。